治疗高血压病肝风上扰证，应首选
A. 龙胆泻肝汤
B. 天麻钩藤饮
C. 镇肝熄风汤
D. 半夏白术天麻汤
E. 地黄饮子

正确答案：C。镇肝熄风汤

解析：镇肝熄风汤（C对）可以镇肝息风，滋阴潜阳，用于治疗高血压病肝风上扰证。龙胆泻肝汤（A错）主要用于清泻肝胆湿热、肝胆实火。天麻钩藤饮（B错）主治肝阳上亢证。半夏白术天麻汤（D错）主治痰湿内盛证。地黄饮子（E错）主要具有阴阳双补的功效。